中国药典中，薄层色谱法在检查中主要应用于
A. 一般杂质检查
B. 水分的测定
C. 有机溶剂残留量的测定
D. 溶液颜色的检查
E. 有关物质的检查

正确答案：E。有关物质的检查

解析：本题考查薄层色谱法。中国药典中，薄层色谱法在检查中主要应用于有关物质的检查（E对）。薄层色谱法具有分离效率高、灵敏、简便等特点，常用于有关物质检查。一般杂质检查（A错）主要用化学分析法。水分的测定（B错）主要用干燥失重法。有机溶剂残留量的测定（C错）主要用气相色谱法。溶液颜色的检查（D错）主要为化学分析法，用于一般杂质的限量检查。